关于拟紫外线断裂剂的描述错误的是
A. 诱发DNA双链断裂
B. 需经S期复制才看见染色体断裂
C. 依赖断裂剂
D. 射性断裂剂不同

正确答案：A。诱发DNA双链断裂

解析：本题考查拟紫外线断裂剂。拟紫外线断裂剂诱发DNA单链断裂（A错，为本题正确答案）；需经S期复制才看见染色体断裂（B对）；是依赖断裂剂（C对）；与放射性断裂剂不同（D对）。